下列情况哪项医疗机构不承担赔偿责任的情形
A. 医务人员在诊疗活动中未尽到与当时的医疗水平相应的诊疗义务，造成患者损害的
B. 泄露患者隐私或者未经患者同意公开其病历资料，造成患者损害的
C. 对于医疗风险、替代医疗方案等情况，未取得患者及家属书面同意的
D. 限于当时的医疗水平难以诊疗
E. 不宜向患者说明的，未向患者的近亲属说明，不必取得患者书面同意

正确答案：D。限于当时的医疗水平难以诊疗

解析：患者有损害，因下列情形之一的，医疗机构不承担赔偿责任：①患者或者其近亲属不配合医疗机构进行符合诊疗规范的诊疗；②医务人员在抢救生命垂危的患者等紧急情况下已经尽到合理诊疗义务；③限于当时的医疗水平难以诊疗。但是在患者或者其近亲属不配合医疗机构进行符合诊疗规范的诊疗情形中，医疗机构及其医务人员也有过错的，应当承担相应的赔偿责任。掌握“医疗损害责任”知识点。